关于急性根尖周脓肿与急性牙周脓肿的鉴别，以下错误的是
A. 急性牙周脓肿靠近根尖
B. 急性根尖周脓肿范围较大
C. 急性牙周脓肿叩痛较轻
D. 慢性根尖周炎急性发作者，X线可见透射影
E. 急性牙周脓肿病程相对较短

正确答案：A。急性牙周脓肿靠近根尖

解析：本题考查急性根尖周脓肿与急性牙周脓肿的鉴别。关于急性根尖周脓肿与急性牙周脓肿的鉴别错误的是急性牙周脓肿靠近根尖（A错，为本题的正确答案）。急性牙周脓肿肿胀部位靠近牙龈缘而不是根尖，范围局限于牙周袋，叩痛相对较轻（C对），病程相对较短（E对），一般三四天可自溃，X线表现为牙槽骨破坏，有骨下袋形成。急性根尖周脓肿脓肿靠近根尖部，范围较大（B对），叩痛很重，病程相对较长，脓液自根尖周向外排出需要五六天，X线无异常表现，若为慢性根尖周炎急性发作者，根尖部骨质吸收，X线可见透射影（D对）。